脂肪乳用于脂质肾病患者，属于
A. 超适应证给药
B. 有禁忌症用药
C. 盲目联合用药
D. 撒网式给药
E. 过度治疗用药

正确答案：B。有禁忌症用药

解析：本题考查有禁忌症用药。脂肪乳用于脂质肾病患者，属于有禁忌症用药（B对）。有禁忌症用药是指忽略药品说明书的提示及忽略病情和患者的基础疾病。超适应证用药（B错）是指用药超越说明书的适应证范围。盲目联合用药（C错）是指没有明确的指征而联合用药。撒网式用药（D错）是指疾病诊断明确后，采取多种相同疗效的药物同时治疗。过度治疗用药（E错）表现在滥用抗菌药物、糖皮质激素、人血白蛋白、二磷酸果糖及肿瘤辅助治疗药等，或无治疗指征过度补钙。